某女，33岁。浮肿1年，腰以下为甚，按之凹陷，不易恢复，脘腹胀闷，纳少，面色不华，神疲乏力，四肢倦怠，畏寒，小便短少，大便溏薄；舌淡苔白腻，脉沉缓。诊断为水肿。宜选用的基础方剂是
A. 疏凿饮子
B. 济生肾气丸
C. 甘姜苓术汤
D. 实脾饮
E. 越婢加术汤

正确答案：D。实脾饮

解析：本题考查的是水肿的辨证论治。某女，33岁。浮肿1年，腰以下为甚，按之凹陷，不易恢复，脘腹胀闷，纳少，面色不华，神疲乏力，四肢倦怠，畏寒，小便短少，大便溏薄；舌淡苔白腻，脉沉缓。诊断为水肿。宜选用的基础方剂是实脾饮（D对）。水肿是体内水液潴留，泛滥肌肤，表现以头面、眼睑、四肢、腹背，甚至全身浮肿为特征的疾病。西医学中各种原因引起的水肿，如急、慢性肾小球肾炎、肾病综合征、继发性肾小球疾病等，以及肝性水肿、心性水肿、营养不良性水肿、功能性水肿、内分泌失调引起的水肿等，可参考此内容辨证论治。（一）风水相搏证：【症状】眼睑浮肿，继则四肢及全身皆肿，来势迅速，多有恶寒、发热，肢节酸楚，小便不利等。偏于风热者，伴咽喉红肿疼痛，舌质红，脉浮滑数；偏于风寒者，兼恶寒，咳喘，舌苔薄白，脉浮滑或浮紧。【方剂应用】基础方剂为越婢加术汤（麻黄、石膏、甘草、大枣、白术、生姜）加减（E错）。（二）水湿浸渍证：【症状】全身水肿，下肢明显，按之没指，小便短少，身体困重，胸闷，纳呆，泛恶。苔白腻，脉沉缓。起病缓慢，病程较长。【方剂应用】基础方剂为五皮散（生姜皮、桑白皮、陈皮、大腹皮、茯苓皮）合胃苓汤（甘草、茯苓、苍术、陈皮、白术、肉桂、泽泻、猪苓、厚朴、生姜、大枣）加减。（三）湿热壅盛证：【症状】遍体浮肿，皮肤绷急光亮，胸脘痞闷，烦热口渴，小便短赤，或大便干结。舌红，苔黄腻，脉沉数或濡数。【方剂应用】基础方剂为疏凿饮子（泽泻、赤小豆、商陆、羌活、大腹皮、椒目、木通、秦艽、槟榔、茯苓皮、生姜）加减（A错）。（四）脾阳虚衰证：【症状】身肿日久，腰以下为甚，按之凹陷不易恢复，脘腹胀闷，纳减便溏，面色不华，神疲乏力，四肢倦怠，小便短少。舌质淡，苔白腻或白滑，脉沉缓或沉弱。【方剂应用】基础方剂为实脾饮（厚朴、白术、木瓜、木香、草果仁、槟榔、附子、茯苓、干姜、炙甘草、生姜、大枣）加减。（五）肾阳衰微证：【症状】水肿反复消长不已，面浮身肿，腰以下甚，按之凹陷不起，尿量减少或反多，腰酸冷痛，四肢厥冷，怯寒神疲，面色㿠白，甚者心悸胸闷，喘促难卧，腹大胀满。舌质淡胖，苔白，脉沉细或沉迟无力。【方剂应用】基础方剂为济生肾气丸（附子、车前子、山茱萸、山药、牡丹皮、牛膝、熟地黄、肉桂、茯苓、泽泻）合真武汤（茯苓、芍药、白术、生姜、附子）加减（B错）。寒湿腰痛：【症状】腰部冷痛重着，转侧不利，逐渐加重，静卧疼痛不减，寒冷和阴雨天加重。舌质淡，苔白腻，脉沉而迟缓。【方剂应用】基础方剂为甘姜苓术汤（甘草、干姜、茯苓、白术）加减（C错）。